关于密质骨的分布，下列说法正确的是
A. 密质骨表面有致密的不同厚度的哈弗系统的骨
B. 密质骨深部为平行骨板
C. 上颌前牙区唇侧密质骨很厚
D. 上颌牙槽骨腭侧骨板增厚
E. 下颌的密质骨颊侧比舌侧厚

正确答案：D。上颌牙槽骨腭侧骨板增厚

解析：密质骨是牙槽骨的外表部分，表面（B错）为平行骨板，深部（A错）有致密的不同厚度的哈弗系统的骨。其在上颌前牙区唇侧骨板很薄（C错），而腭侧增厚（D对）。下颌的骨板舌侧比颊侧（E错）厚，但在磨牙区颊侧骨板也增厚。